中医理论体系的主要特点是
A. 急则治标，缓则治本
B. 辨病与辨证相结合
C. 整体观念和辨证论治
D. 异病同治和同病异治
E. 以上都不是

正确答案：C。整体观念和辨证论治

解析：中医学理论体系的主要特点，包括整体观念和辨证论治两个方面（C对）。整体观念是中医学认识人体自身及人与环境之间联系性和统一性的学术思想。辨证论治是中医学认识疾病和治疗疾病的基本原则。“急则治标，缓则治本”属于中医学治疗疾病的基本治疗原则（A错）。“辨病与辨证相结合”“异病同治和同病异治”都属于“辨证论治”（BDE错）。